急性化脓性骨髓炎主要的病原菌
A. 金黄色葡萄球菌和放线菌
B. 金黄色葡萄球菌和链球菌
C. 金黄色葡萄球菌和芽孢杆菌
D. 乙型溶血性链球菌和芽孢杆菌
E. 乙型溶血性链球菌和放线菌

正确答案：B。金黄色葡萄球菌和链球菌

解析：本题考查急慢性化脓性颌骨骨髓炎。急性化脓性骨髓炎多来自于牙源性感染，常继发急性根尖周脓肿和根尖周肉芽肿或根尖周囊肿等慢性根尖病变，少数情况亦可由外伤后感染和血行感染引起。病原菌主要为金黄色葡萄球菌和链球菌（B对）。